妊娠期服用糖皮质激素，可能导致骨质疏松症以外的不良反应是
A. 婴儿生长发育抑制
B. 血压升高
C. 胎盘功能不全
D. 支气管哮喘
E. 儿童生长发育抑制

正确答案：C。胎盘功能不全

解析：本题考查糖皮质激素的使用。妊娠期服用糖皮质激素，可能导致骨质疏松症以外的不良反应是胎盘功能不全（C对）。糖皮质激素可通过胎盘屏障。妊娠期妇女使用药理剂量的糖皮质激素可增加胎盘功能不全、新生儿体重减少或死胎的发生率。婴儿生长发育抑制（A错）是哺乳期妇女使用糖皮质激素的不良反应。血压升高（B错）是老年人使用糖皮质激素的不良反应。支气管哮喘（D错）是糖皮质激素的适应证。儿童生长发育抑制（E错）是儿童使用糖皮质激素的不良反应。